关于流产的治疗原则，下列哪项是错误的
A. 难免流产应行刮宫术
B. 不全流产应行刮宫术
C. 患者自述阴道有组织物从阴道内排出，但阴道流血未见减少，应行刮宫术
D. 感染性流产出血不多，应抗感染及刮宫同时进行
E. 子宫颈内口松弛者，应在妊娠12～14周时行子宫颈内口缝扎术

正确答案：D。感染性流产出血不多，应抗感染及刮宫同时进行

解析：流产合并感染的治疗原则应积极控制感染，若阴道流血不多，应用广谱抗生素2～3日，待控制感染后再行刮宫，清除宫腔残留组织以止血。若阴道流血量多，静脉滴注广谱抗生素和输血的同时，用卵圆钳将宫腔内残留组织夹出，使出血减少，切不可用刮匙全面搔刮宫腔，以免造成感染扩散。术后继续应用抗生素，待感染控制后再行彻底刮宫。掌握“自然流产”知识点。